诱导持续时间较长并有交叉保护性免疫的疫苗是
A. 亚单位疫苗
B. 裂解疫苗
C. 全病毒灭活疫苗
D. 减毒活疫苗
E. 流感病毒基因工程疫苗

正确答案：D。减毒活疫苗

解析：本题考查流感病毒的疫苗种类。减毒灭活疫苗（D对ABCE错）是由流感病毒通过减毒得到，生产过程简单，价格便宜。其诱导持续时间较长并有交叉保护性免疫，再受到病毒感染时危害性明显降低。